七厘散成人口服的一次用量是
A. 0.3～0.5g
B. 1.0～1.5g
C. 0.6～0.9g
D. 1.6～3.0g
E. 5.0～9.0g

正确答案：B。1.0～1.5g

解析：本题考查的是七厘散的用法用量。七厘散成人口服的一次用量是1.0～1.5g（B对）。七厘散：【用法用量】散剂：口服，一次1～1.5g，一日1～3次；外用，调敷患处。胶囊剂：口服，一次2～3粒，一日1～3次；外用，以内容物调敷患处。